IQ=[13（X-M）/S]+100称为
A. 比率智商
B. 离差智商
C. 百分位智商
D. 中位数智商
E. 人格智商

正确答案：B。离差智商